损伤后出现同侧肢体本体感觉丧失
A. 薄束和楔束
B. 脊髓丘脑侧束
C. 三叉神经脊束
D. 三叉丘系
E. 无

正确答案：A。薄束和楔束

解析：本体感觉传导通路第 2 级神经元的胞体在薄、楔束核内，二核发出的纤维向前绕过中央灰质的腹侧，在中线上与对侧的交叉，交叉后的纤维转折向上，因此薄束和楔束（A对）；